与胃黏膜相关淋巴组织淋巴瘤（胃MALT淋巴瘤）发病有关的感染是
A. Hp感染
B. HPV感染
C. HIV感染
D. EBV感染
E. HTLV-1感染

正确答案：A。Hp感染

解析：与胃黏膜相关淋巴组织淋巴瘤（胃MALT淋巴瘤）发病有关的感染是Hp感染（A对）。与HPV感染（B错）有关的疾病是尖锐湿疣，宫颈癌。与EBV感染（D错）有关的疾病有：①传染性单核细胞增多症；②Burkitt淋巴瘤；③鼻咽癌；④淋巴组织增生性疾病。